关于妊娠期及哺乳期妇女用药指导的说法，正确的有
A. 选择临床中使用时间长且安全的药物
B. 给药时注意从低剂量开始
C. 注意用药妊娠禁忌
D. 哺乳期间一天只服用一次的药物，建议早上服用
E. 对于一天服用多次的药物，建议哺乳后立即给药

正确答案：A、B、C、E。选择临床中使用时间长且安全的药物；给药时注意从低剂量开始；注意用药妊娠禁忌；对于一天服用多次的药物，建议哺乳后立即给药

解析：本题考查的是需特殊提醒的用药人群。关于妊娠期及哺乳期妇女用药指导的说法，正确的有选择临床中使用时间长且安全的药物（A对）、给药时注意从低剂量开始（B对）、注意用药妊娠禁忌（C对）、对于一天服用多次的药物，建议哺乳后立即给药（E对）。妊娠期及哺乳期妇女的用药：妊娠期及哺乳期妇女的药品使用关系到母子双方的安全，执业药师在指导用药时，要充分考虑此类患者的生理和药动学特点，选择临床中使用时间长且安全的药物，注意从低剂量开始。使用中药时，要注意中药之间的配伍，注意妊娠禁忌。使用西药时，要尽量选择半衰期短、高蛋白结合、生物利用度低和低脂溶性药物。要关注药品说明书中“妊娠和哺乳期妇女用药”项下的内容，禁止指导使用其项下规定禁止使用的药物。对患者要进行用药教育，对于一天只服一次的药品，建议晚上给药（D错），这样可延长与哺乳时间的间隔。对于一天服用多次的药物建议哺乳后立即给药，要告知患者不能自行用药。